通过在分散相与连续相的界面上发生单体的缩聚反应，生成微囊囊膜以制备微囊的方法
A. 界面缩聚法
B. 辐射交联法
C. 喷雾干燥法
D. 液中干燥法
E. 单凝聚法

正确答案：A。界面缩聚法